前列腺癌临床分期常用的检查是
A. 前列腺穿刺活检
B. 直肠指检
C. 前列腺MRI
D. 前列腺B超
E. 血清PSA检查

正确答案：C。前列腺MRI

解析：前列腺癌临床分期多采用TNM分期系统，常采用的检查方法是前列腺MRI（C对）。前列腺MRI可以清楚的显示前列腺癌的浸润深度和侵及范围，对前列腺癌的临床分期具有重要意义。前列腺穿刺活检（A错）、直肠指检（B错）及血清PSA检查（E错）是诊断前列腺癌的主要方法，对前列腺癌临床分期的价值不大。前列腺B超（D错）可以显示前列腺癌的大小及其侵及范围，但显示效果不及MRI。